男，65岁突发上腹痛1天，发热6小时，呼吸困难1小时，查体：T38.6℃，R32次/分，BP90/60mmHg，P110次/分，巩膜轻度黄染，上腹部压痛，轻度肌紧张。肠鸣音1次/分。血淀粉酶860U/L，血氧分压50mmHg。首先考虑诊断是
A. 急性胆管炎并感染中毒性休克
B. 肠系膜动脉栓塞
C. 肺炎
D. 急性心肌梗死
E. 急性胰腺炎合并呼吸窘迫综合征

正确答案：E。急性胰腺炎合并呼吸窘迫综合征

解析：老年男性患者，突发上腹痛1天、发热6小时（急性胰腺炎的常见症状）。查体见巩膜轻度黄染，上腹部压痛、轻度肌紧张，肠鸣音1次/分（正常为4～5次/分，提示肠鸣音减少）（黄疸、腹膜刺激征、肠鸣音减少均为急性胰腺炎的常见体征），初步考虑诊断为急性胰腺炎。患者BP90/60mmHg（正常血压＞90/60mmHg，提示血压降低），P110次/分（正常为60～100次/分，提示心率增快），出现休克的表现，可进一步诊断为重症急性胰腺炎。重症急性胰腺炎易并发各种并发症，患者出现呼吸困难1小时，R32次/分（正常为16～20次/分，提示呼吸增快），血氧分压50mmHg（正常为95～100mmHg，提示血氧分压降低），考虑合并呼吸窘迫综合征。综上，患者首先考虑诊断为急性胰腺炎合并呼吸窘迫综合征（E对）。急性胆管炎并感染中毒性休克（九版外科学P446）（A错）主要表现为Reynolds五联征，即腹痛、寒战高热、黄疸、休克、神经系统症状。肠系膜动脉栓塞（九版外科学P365）（B错）主要表现为突发剧烈腹部绞痛，难以用一般药物所缓解，恶心呕吐频繁，且常为血性，肠鸣音活跃或正常，严重的症状与轻微的腹部体征不相称。肺炎（P42）（C错）主要表现为咳嗽、咳痰、或原有呼吸道症状加重，伴或不伴胸痛，一般不会出现消化道症状。急性心肌梗死（P236）（D错）主要表现为发作性心前区疼痛，患者常有胸闷或濒死感，偶可表现为上腹痛，但不会出现压痛、肌紧张（腹膜刺激征）等体征。